原发性醛固酮增多症患者出现肌无力的原因是
A. 持续性高血压
B. 血钠潴留过多
C. 持久尿量过多
D. 尿钾排出增多
E. 血钾浓度降低

正确答案：E。血钾浓度降低

解析：原发性醛固酮增多症患者出现肌无力的原因是血钾浓度过低（E对）。发生机制为患者因醛固酮分泌过多导致水Na⁺潴留和K⁺丢失，大量丢钾会导致一系列神经、肌肉、肌肉及肾功能障碍，血钾越低，肌肉受累越明显，有时仅可表现为乏力，也可出现典型的周期性瘫痪，严重者累及呼吸系统致呼吸和吞咽困难，劳累和服用排K⁺利尿药物肠胃诱因及加重症状。